患者，男，31岁。颈项部皮肤增厚，干燥，瘙痒较剧，情绪波动时，瘙痒随之加剧，部分皮肤因反复搔抓形成苔藓样变化。其诊断是
A. 接触性皮炎
B. 牛皮癣
C. 白疕
D. 慢性湿疮
E. 紫白癜风

正确答案：B。牛皮癣

解析：牛皮癣，是一种皮肤状如牛项之皮，厚且坚的慢性瘙痒性皮肤病，相当于西医的神经性皮炎，本病例项部皮肤增厚，干燥，瘙痒，与情绪相关，可形成苔藓样变化，皮损特点与之相符，故诊断牛皮癣（B对）。接触性皮炎是指因皮肤或黏膜接触某些外界物质所引起的皮肤急性或慢性炎症反应，其特点是发病前均有明显的接触某种物质的病史，皮疹一般为红斑、肿胀、丘疹、水疱或大疱、糜烂、渗出等，一个时期内以某一种皮损为主，本病例皮损特点与之不符（A错）。白疕，因其‘肤如疹疥，色白而痒，搔起皮疹’而得名，是一种常见的易于复发的炎症性皮肤病，相当于西医的银屑病，其特点是：在红斑上有松散的银白色鳞屑，抓之有薄膜及露水珠样出血点，本病例皮损特点与之不符（C错）。湿疮，是一种过敏性炎症性皮肤病，相当于西医的湿疹，其特点是：皮损对称分布，多形损害，剧烈瘙痒，有渗出倾向，反复发作，易呈慢性，慢性湿疮以苔癣样变为主，易反复发作，本病例皮损特点与之不符（D错）。紫白癜风，因病变处损害以紫斑、白斑而得名，又因夏季出汗后皮疹明显，俗称汗斑，相当于西医的花斑癣，其特点是初起皮肤上出现豌豆之蚕豆大小的斑片，色淡红或赤紫，继则游走成片，上有细小糠秕状鳞屑，刮之更明显，微微发亮，将愈时呈灰白色斑片，好发于颈侧、胸背、肩胛、腋窝，下部躯干、乳下、会阴等处，冬轻夏重，本病例皮疹特点与之不符（E错）。